患儿，男，6个月。夜惊多汗，烦躁不安，面色不华，纳食不佳，枕秃，舌淡苔白，指纹淡。实验室检查：血钙磷乘积稍低，血碱性磷酸酶升高。诊断为佝偻病，其分期及证型是
A. 活动早期，肾精亏损
B. 活动早期，肾虚骨弱
C. 活动早期，脾气虚弱
D. 活动期，肾精亏损
E. 活动期，肾虚骨弱

正确答案：C。活动早期，脾气虚弱

解析：本病例已明确诊断佝偻病。初期，常见于3～6个月内的小婴儿，主要表现为神经兴奋性增高，如有烦躁、睡眠不安、易惊、夜啼、多汗等症，并可致枕部脱发而见枕秃。血生化改变轻微，血清25-（OH）D3下降，血钙正常或略下降，血磷降低，碱性磷酸酶正常或稍高，骨骼X线摄片可无异常，或见临时钙化带稍模糊。据患儿发病年龄、临床症状与体征，结合实验室检查，故其分期为初期（旧教材表述为活动早期）。脾失健运，无以输布水谷精微，病久全身脏腑失于濡养，则见面色不华，纳食不佳；脾虚肝失所制，则肝木亢盛，则夜惊，烦躁不安；肺气不足，卫外不固，则多汗；肾虚骨髓不充，骨失所养，则出现枕秃，故其证型为脾气虚弱证（有教材表述为脾气虚弱证）（C对）。肾精亏损（新教材表述为脾肾亏损）多见于活动期，临床以多汗、纳呆乏力、烦躁夜啼，伴明显骨骼改变为特征（AD错）。肾虚骨弱证多见于本病的恢复期及后遗症期，临床以遗留明显骨骼畸形为特征（BE错）。